口腔白膜的真菌感染的治疗药物为
A. 氟康唑
B. 制霉菌素
C. 两性霉素
D. 伊曲康唑
E. 伏立康唑

正确答案：B。制霉菌素

解析：口腔白膜的真菌感染考虑为鹅口疮，为白念珠菌感染在口腔黏膜表面形成白色斑膜的疾病。多见于新生儿和婴幼儿，营养不良、腹泻、长期使用广谱抗生素或类固醇激素的患儿，常局部涂抹10万~20万U/ml制霉菌素溶液（B对）治疗。